卫生服务需求形成的条件是
A. 消费者的便利程度和购买愿望
B. 消费者的购买愿望和服务提供者的水平
C. 消费者的购买愿望和支付能力
D. 消费者的支付能力和便利程度
E. 消费者的支付能力和服务提供者的水平

正确答案：C。消费者的购买愿望和支付能力

解析：卫生服务需求是指实际发生的、消费者有支付能力的卫生服务。其有两个基本条件：①卫生服务的愿望。任何人难免生病，一旦健康受到损害，就有卫生服务的愿望；②消费者有支付能力。为了获得卫生服务就需要付出代价，当消费者既有获得服务的愿望又有支付能力时，才能产生有效的需求（C对）。